渗出液与漏出液的主要差异在于
A. 液体量的多少不同
B. 蛋白含量多少不同
C. 发生的部位不同
D. 发生的年龄不同
E. 发生时间不同

正确答案：B。蛋白含量多少不同

解析：漏出液外观清澈透明，无色或浅黄色，不凝固；而渗出液外观颜色深，呈透明或浑浊的草黄或棕黄色，或血性，可自行凝固。两者划分标准多根据比重(以1.018为界）、蛋白质含量(以30g/L为界）、白细胞数(以500x106/L为界），小于以上界限为漏出液，反之为渗出液，但其诊断的敏感性和特异性较差。目前多根据Light标准，符合以下任何1项可诊断为渗出液：①胸腔积液/血清蛋白比例>0.5；②胸腔积液/血清LDH比例>0.6；③胸腔积液LDH水平大于血清正常值高限的2/3（B对）。